生理性胎黄的特点是
A. 黄疸常于生后1~2天出现
B. 黄疸常于生后1周消退
C. 早产儿黄疸轻，消退早
D. 早产儿黄疸重，消退晚
E. 早产儿与足月产儿无明显差别

正确答案：D。早产儿黄疸重，消退晚

解析：胎黄以婴儿出生后皮肤面目出现黄疸为特征，早产儿生理性黄疸消退慢，症状较足月儿严重（D对）。生理性黄疸大部分在出生后第2-3天出现黄疸（A错）。足月儿在出生后10-14天消退（B错）。早产儿生理性黄疸持续时间较长，症状较重（C错）。早产儿与足月产儿其持续时间及症状有差别（E错）。